下列辅料中，崩解剂是
A. PEG
B. HPMC
C. PVP
D. CMC-Na
E. CCMC-Na

正确答案：E。CCMC-Na

解析：本题考查片剂的常用辅料。崩解剂系指促使片剂在胃肠液中迅速破裂成细小颗粒的辅料。常用的崩解剂有：干淀粉、羧甲基淀粉钠（CMS-Na）、低取代羟丙基纤维素、交联羧甲基纤维素钠（CCMC-Na）（E对）、交联聚维酮（PVPP）和泡腾崩解剂（碳酸氢钠和枸橼酸组成的混合物，也可以用柠檬酸、富马酸与碳酸钠、碳酸钾、碳酸氢钾）等。PEG（聚乙二醇类）（A错）为润滑剂、黏合剂。HPMC（羟丙基甲基纤维素）（B错）、PVP（聚维酮）（C错）、CMC-Na（羧甲基纤维素钠）（D错）均为黏合剂。